最易形成潜伏感染的病毒是
A. 麻疹病毒
B. 流感病毒
C. 狂犬病
D. 脊髓灰质炎
E. 水痘-带状疱疹病毒

正确答案：E。水痘-带状疱疹病毒

解析：潜伏感染指显性或隐性感染后，病毒基因存在于组织或细胞内，但并不能产生感染性病毒粒子（病毒体），在某些条件下可被激活而出现临床急性发作。病毒仅在临床出现间歇性急性发作时才能被检出，在非发作期，用一般常规方法不能分离出病毒。如单纯疱疹病毒1型感染后，在三叉神经节中潜伏，此时既无临床症状也无病毒排出。当机体受物理、化学、或环境等因素影响时，使潜伏的病毒增殖，沿感觉神经到达皮肤，发生唇疱疹。又如水痘-带状疱疹病毒初次感染主要在儿童引起水痘，病愈后，病毒潜伏在脊髓后根神经节或脑神经的感觉神经节细胞内，暂时不显活性，当局部神经受冷、热、压迫或X线照射以及患肿瘤等机体免疫功能下降时，潜伏的病毒则活化并增殖，进而沿神经干扩散到皮肤发生带状疱疹。病愈后病毒又回到潜伏部位。掌握“病毒传播方式、感染类型、致病机制及免疫”知识点。